下列属于抗结核药的是
A. 阿米卡星
B. 红霉素
C. 土霉素
D. 阿昔洛韦
E. 利福喷丁

正确答案：A、E。阿米卡星；利福喷丁

解析：本题考查抗结核药。阿米卡星（A对）、利福喷丁（E对）属于抗结核药。阿米卡星为第二线抗结核药，与第一线相比，其疗效较差，毒副作用较多，为结核病次选药物。红霉素（B错）为大环内酯类抗生素，抗菌谱与青霉素相似，且对支原体，衣原体，立克次体等及军团菌有抗菌作用，适用于支原体肺炎、沙眼衣原体引起的新生儿结膜炎、婴儿肺炎。土霉素（C错）为广谱抑菌剂。阿昔洛韦（D错）是核苷类抗病毒药。